肝癌的特异性标记物是
A. 甲胎蛋白(AFP）
B. y-谷氨酰转肽酶同工酶Ⅱ(CGT-Ⅱ）
C. 异常凝血酶原(AP）
D. α-L-岩藻糖苷酶（AFU）
E. 酸性同工铁蛋白(AIF）

正确答案：A。甲胎蛋白(AFP）

解析：AFP（甲胎蛋白）是在胎儿早期由肝脏和卵黄囊合成的一种血清糖蛋白，出生后，AFP的合成很快受到抑制。当肝细胞或生殖腺胚胎组织发生恶性病变时，有关基因重新被激活，使原来丧失合成AFP的细胞又重新开始合成，以致血中AFP含量明显升高。因此原发性肝细胞性肝癌最理想的肿瘤标记物是AFP（A对）。y-谷氨酰转肽酶同工酶Ⅱ(CGT-Ⅱ）（九版诊断学P364）（B错）为γ-谷氨酰转移酶的中分子量形式，一种成分主要用于和AFP联合检测诊断肝癌，另一种成分主要用于胆道阻塞性疾病的诊断。γ-谷氨酰转肽酶（B错）、异常凝血酶原（C错）、α-L岩藻糖苷酶（D错）、碱性磷酸酶（E错）都有助于肝细胞癌的诊断，尤其是在AFP阴性的肝癌患者，但是特异性不高。